接受双侧皮质核束支配的肌是
A. 表情肌、咀嚼肌、眼外肌、腭肌和咽喉肌
B. 表情肌、咀嚼肌、眼外肌、腭肌、咽喉肌和舌肌
C. 额肌、眼轮匝肌、咀嚼肌、眼外肌、腭肌和咽喉肌
D. 额肌、眼轮匝肌、咀嚼肌、眼外肌、腭肌、咽喉肌和膈肌
E. 额肌、眼轮匝肌、咀嚼肌、眼外肌、膊肌、咽喉肌、膈肌和舌肌

正确答案：C。额肌、眼轮匝肌、咀嚼肌、眼外肌、腭肌和咽喉肌

解析：因为面神经核下部和舌下神经核只接受单侧（对侧）皮质核束支配，所以需排除二者支配的肌肉，面神经支配额肌、眼轮匝肌、颊肌、口轮匝肌及其他口周围肌，舌下神经支配舌肌。经排除法可得接受双侧皮质核束支配的肌是额肌、眼轮匝肌、咀嚼肌、眼外肌、腭肌和咽喉肌（C对）。